抽样误差最小的抽样方法是
A. 单纯随机抽样
B. 系统抽样
C. 分层抽样
D. 整群抽样
E. 典型抽样

正确答案：C。分层抽样

解析：本题考查抽样误差最小的抽样方法。分层抽样（C对ABDE错）是从一个可以分成不同子总体（或称为层）的总体中，按规定的比例从不同层中随机抽取样品（个体）的方法。该方法的优点是样本的代表性比较好，抽样误差比较小。